治疗噎膈痰气交阻证，应首选
A. 通幽汤
B. 丁香散
C. 启膈散
D. 通关散
E. 四七汤

正确答案：C。启膈散

解析：通幽汤功能养血活血，润燥通幽，是噎膈瘀血内结证的选方（A错）。丁香散功能温中散寒，降逆止呃，是呃逆胃中寒冷证的选方（B错）。噎膈痰气交阻证的病机是肝气郁结，痰湿交阻，胃气上逆，治疗时应该开郁化痰，润燥降气，选启膈散（C对）。通关散功能通关开窍，合五磨饮子可治疗厥证气厥实证（D错）。四七汤即半夏厚朴汤加大枣，功能行气散结，降逆化痰，噎膈痰气交阻证若痰气瘀结、痞塞满闷可选用，不是首选方（E错）。